典型的结核病局部病变不表现为
A. 结节
B. 肉芽肿
C. 干酪样坏死
D. 冷脓肿
E. 红肿热痛

正确答案：E。红肿热痛

解析：结核病是由结核杆菌引起的一种慢性肉芽肿病（B对），其典型病变为结核结节（A对）形成伴有不同程度的干酪样坏死（C对）。骨结核时，坏死物液化后在骨旁形成结核性“脓肿”，由于局部并无红、热、痛（E错，为本题正确答案），故又称“冷脓肿（D对）。